由元参、麦冬、犀角、银花、黄连、生地、连翘、竹叶心、丹参组成的方剂是
A. 犀角地黄汤
B. 凉膈散
C. 普济消毒饮
D. 仙方活命饮
E. 清营汤

正确答案：E。清营汤

解析：本题考查方剂的组成。清营汤组成犀角、生地黄、元参、竹叶心、 麦冬、 丹参、 黄连、 银花、 连翘（E对）。犀角地黄汤组成犀角、生地黄、芍药、牡丹皮（A错）。凉膈散组成川大黄、朴黄、甘草、山栀子仁、薄荷、黄芩、连翘（B错）。普济消毒饮组成黄芩、黄连、陈皮、甘草、玄参、柴胡、桔梗、连翘、板蓝根、马勃、牛蒡子、薄荷、僵蚕、升麻（C错）。仙方活命饮组成白芷、贝母、防风、赤芍药、当归尾、甘草节、皂角刺、穿山甲、天花粉、乳香、没药、金银花、陈皮（D错）。